形成肾小囊超滤液的有效滤过压等于
A. 肾小球毛细血管压﹢血浆胶体渗透压﹢囊内压
B. 肾小球毛细血管压﹣血浆胶体渗透压﹣囊内压
C. 肾小球毛细血管压﹢血浆胶体渗透压﹢囊内压
D. 肾小球毛细血管压﹣血浆胶体渗透压﹢囊内压
E. 肾小球毛细血管压﹣（血浆胶体渗透压﹣囊内压）

正确答案：B。肾小球毛细血管压﹣血浆胶体渗透压﹣囊内压